下颌智齿冠周炎沿下颌支外侧面向后可形成
A. 翼颌间隙感染
B. 颌下间隙感染
C. 咽旁间隙感染
D. 咬肌间隙感染
E. 口底蜂窝织炎

正确答案：D。咬肌间隙感染

解析：咬肌间隙感染来源主要来自下颌智牙冠周炎及下颌磨牙的根尖周炎扩散而进入咬肌间隙；也可来源于磨牙后三角区黏膜的感染；相邻间隙如颞下间隙感染的扩散；偶有因化脓性腮腺炎波及者。掌握“间隙感染概述、眶下间隙、咬肌间隙感染”知识点。